活血化瘀药的主要归经是
A. 心经
B. 肝经
C. 二者均是
D. 二者均不是

正确答案：C。二者均是

解析：本题考查的是活血化瘀药的归经。活血化瘀药的主要归经是心经与肝经（C对）。凡以通利血脉、促进血行、消散瘀血为主要功效的药物，称为活血祛瘀药或活血化瘀药，简称活血药。其中活血作用较强者，又称破血药。本类药味多辛、苦，多归心、肝经（AB错）而入血分，善走散通利，促进血行。主具活血化瘀之功，并通过活血化瘀而产生调经、止痛、消癥、消肿及祛瘀生新等作用。